治疗湿热型崩漏，宜配用
A. 中极、血海
B. 膈俞、血海
C. 中极、阴陵泉
D. 阴陵泉、太冲
E. 膻中、太冲

正确答案：C。中极、阴陵泉

解析：湿热型崩漏多因内蕴湿热之邪，热伤冲任，迫血妄行，发为崩漏。中极为任脉腧穴，膀胱之募穴，具有补肾调经，清利湿热的功效；阴陵泉为足太阴脾经合穴，有健脾祛湿的功效；故治疗湿热型崩漏宜配用中极、阴陵泉（C对）。